给病人提供合理用药的正确指导是
A. 药品采购供应的职业道德
B. 药品安全储运的道德要求
C. 药品生产企业销售的工作道德
D. 药品调剂配发的工作道德
E. 药品广告宣传的道德责任

正确答案：D。药品调剂配发的工作道德